确定食品中可能产生不良健康影响的生物、化学和物理因素的是
A. 危害识别
B. 危害特征描述
C. 暴露评估
D. 风险特征描述
E. 风险管理

正确答案：A。危害识别

解析：本题考查危害识别。确定食品中可能产生不良健康影响的生物、化学和物理因素的是危害识别（A对BCDE错）。